下列关于心力衰竭的叙述错误的是
A. 心室充盈及（或）射血能力受损
B. 心排量可维持正常
C. 是伴有临床症状的心功能不全
D. 常伴肺循环充血
E. 有心功能不全不一定有心力衰竭

正确答案：D。常伴肺循环充血

解析：充血是指局部组织或器官因动脉血输入过多致含血量主动增多的过程；淤血是指静脉血液回流受阻，血液被动淤积在小静脉和毛细血管中，使局部组织或器官的含血量增多。慢性左心衰时，左心室射血功能障碍，导致左心室舒张末压升高，舒张期左心房内血流无法顺利流入左心室，引起左心房压力升高，左心房压升高使得肺静脉血液回流受阻，出现肺循环淤血，而不是肺循环的主动充血（D错，为本题正确答案）。心力衰竭患者由于心脏结构或功能性疾病导致心室充盈及（或）射血能力受损（A对），但发病早期机体通过代偿机制，心排量可维持正常（B对），甲亢或贫血患者合并心衰时，心排出量可维持在正常水平甚至超过正常。心功能不全是指各种原因引起的心脏结构和功能异常及相关临床表现的一个广泛的概念，当心功能不全病情发展，出现相应的临床症状时称为心力衰竭（CE对）。